肠溶空心胶囊囊壳常用的包衣材料是
A. 聚乙二醇（PEG)
B. 聚维酮（PVP）
C. 聚乙烯醇（PVA)
D. 醋酸纤维素酞酸酯（CAP)
E. 羧甲基纤维素钠（CMC—Na)

正确答案：D。醋酸纤维素酞酸酯（CAP)